治疗呃逆气机郁滞证，应首选
A. 丁香散
B. 益胃汤
C. 五磨饮子
D. 竹叶石膏汤
E. 橘皮竹茹汤

正确答案：C。五磨饮子

解析：丁香散功能温中祛寒降逆，为呃逆胃中寒冷证的选方（A错）。益胃汤功能养胃生津，常合橘皮竹茹汤治疗呃逆胃阴不足证（B错）。呃逆气机郁滞证是由于肝气瘀滞，上逆犯胃，导致胃气上逆而发呃逆。治宜顺气解郁，和胃降逆，首选五磨饮子（C对）。竹叶石膏汤功能清热生津，和胃降逆，为呃逆胃火上逆证的选方（D错）。橘皮竹茹汤功能益气清热，和胃降逆，常合益胃汤治疗呃逆胃阴不足证（E错）。